男，35岁。血吸虫病患者，曾用锑剂治疗1次，1年前用吡喹酮治疗1次。近1个月来乏力，腹胀，刷牙易出血。查体：慢性病容，巩膜无明显黄染，腹水征阳性，肝未及，脾肋下7cm。血象：Hb100g/L，WBC3×10⁹/L，N0.65，PLT₄0×10⁹/L。对于患者的诊断和治疗最有意义的检查是
A. 粪便直接涂片
B. 直肠黏膜活检
C. 粪便沉孵法
D. 环卵沉淀试验
E. 皮内试验

正确答案：C。粪便沉孵法

解析：日本血吸虫病是日本血吸虫寄生于门静脉系统所引起的疾病，分为急性、慢性、晚期、异位四型。慢性血吸虫病病程经过半年以上，是急性症状消退而未经治疗或疫区反复轻度感染而获得部分免疫力的病人。本患者是二次发病，病程一年以上，从病程判断为慢性患者。慢性血吸虫病的症状主要为慢性腹泻和脓血黏液便，时轻时重，时发时愈，病程长者可出现肠梗阻、贫血、消瘦、体力下降等。肝脏病变可由早期增大逐渐发展为肝硬化。脾脏逐渐增大。本患者有乏力、腹胀、腹水、脾大等症状，与慢性病症一致。实验室检查方法包括粪便检查、肝功能试验、免疫学检查和直肠黏膜活检。粪便内检查虫卵和孵出毛蚴是确诊血吸虫病的直接依据：1）直接涂片法能发现感染较重的早期病人，本患者不适用（A错）；2）粪便沉淀法和毛蚴孵化法同时进行，可以提高检出效率，应对每个动物采粪样3次，每粪样检查2次，适用于本患者（C对）。肝功能试验不适用于慢性患者，其肝功能试验大多正常。免疫学检查方法较多，包括皮内试验、环卵沉淀试验、间接血凝试验、ELISA和循环抗原酶免疫法这些方法不能区别既往感染与现症患者，并有假阳性假阴性等缺点，故不适用（DE错）。直肠粘膜活检是血吸虫病原诊断方法之一，阳性率较高，适用于临床可疑而粪检阴性者（B错）。